低渗性脱水危及患儿生命的常见情况是
A. 低钾血症
B. 低钙血症
C. 低血容量休克
D. 代谢性酸中毒
E. 中枢神经系统并发症

正确答案：C。低血容量休克

解析：低钾血症（A错）、低钙血症（B错）、代谢性酸中毒（D错）、中枢神经系统并发症（E错）这四种情况在低渗性脱水中少见。低渗性脱水危及患儿生命的常见情况是低血量休克，因为：低渗性脱水时，细胞外液为低渗液，细胞內液为高渗液，于是细胞外的水就会进入细胞内，使细胞外的水分减少即循环血减少，从而引发低血量休克（C对）。